氧需能否得到满足主要取决于哪个系统的功能
A. 呼吸系统
B. 循环系统
C. 骨骼肌肉系统
D. 呼吸系统和循环系统
E. 循环系统和骨骼肌肉系统

正确答案：B。循环系统